高脂饮食可促进其吸收的药物是
A. 维A酸片
B. 左旋多巴片
C. 地衣芽孢杆菌活菌胶囊
D. 非洛地平片
E. 去氨加压素片

正确答案：A。维A酸片

解析：本题考查饮食对药物疗效的影响。维A酸片（A对）属于脂溶性维生素，服药期间进食高脂肪食物可促进药物吸收。左旋多巴（B错）片不宜与高蛋白食物同时服用。地衣芽孢杆菌活菌胶囊（C错）服用期间不可饮茶。非洛地平（D错）通过CYP3A4代谢，葡萄柚汁主要影响CYP3A4代谢，同时抑制CYP3A4的活性，不能同服。去氨加压素（E错）服药期间应限制饮水。